发现牙根进入上颌窦首先应做的是
A. 拍X线片
B. 从穿孔处掏根
C. 冲洗上颌窦
D. 开窗取根
E. 服抗菌药物

正确答案：A。拍X线片

解析：本题考查牙根进入上颌窦的处理方法。发现牙根进入上颌窦首先应做的是拍X线片（A对）。牙根进入上颌窦首先应做的是拍X线片，先确定断根所在位置，然后根据具体情况选择取根方法。在拍完X线片后，根据牙根与上颌窦的关系，若牙根露出的很多，可以直接从穿孔处掏根（B错）；若无法夹持需开窗取根（D错），同时要冲洗上颌窦（C错）减少感染，最后关闭穿孔。为防止感染，可以在术后服抗菌药物（E错），术前没有临床意义。